作为医学伦理学基本范畴的情感指的是
A. 医学关系中的主体在道义上应享有的权力和利益
B. 医学关系中的主体在道义上应履行的职责和使命
C. 医学关系中的主体在道义上对周围人事以及自身的内心体验和感受
D. 医学关系中的主体在对自己应尽义务的自我认识和自我评价的能力
E. 医学关系中的主体在表现出行为前的周密思考和行为中的谨慎负责

正确答案：C。医学关系中的主体在道义上对周围人事以及自身的内心体验和感受

解析：医德情感是指医务人员在医疗活动中对自己和他人行为之间关系的内心体验和自然流露。医务人员的道德情感是与义务紧密联系在一起的，是建立在对病人健康高度负责的基础之上的。医德情感的内容包括同情感、责任感和事业感。同情心是医务人员发自内心的情感。一个正直的医务人员，面对受疾病折磨、盼望救治的病人，会产生同情病人并愿为其解除病痛的情感，这是一个医务人员最起码的道德情感。责任感是起主导作用的医德情感，它已经上升到职业责任的高度，是一种自觉的道德意识。事业感是责任感的升华，是更高层次的医德情感，即把事业看得比个人利益、生命还重要（C对）。